属于软膏剂脂溶性基质的是
A. 十八醇
B. 月桂醇硫酸钠
C. 司盘80
D. 甘油
E. 羟苯乙酯

正确答案：A。十八醇

解析：本题考查软膏剂的基质与附加剂。十八醇（A对）为软膏剂的脂溶性基质。常用基质分为油脂性、水溶性和乳剂型基质。月桂醇硫酸钠（B错）为软膏剂的O/W型乳化剂；司盘80（C错）为W/O型乳化剂；甘油（D错）常作为软膏剂的保湿剂使用；羟苯乙酯（E错）常作为软膏剂的防腐剂使用。